导致支气管哮喘的原因
A. IgE
B. IgG
C. IgA
D. IgD
E. IgM

正确答案：A。IgE

解析：支气管哮喘是IgE介导的以慢性气道炎症和气道高反应为特征的疾病（A对）。